判断酮症的指标是，血中酮体水平
A. ＞40mg/dl
B. ＞50mg/dl
C. ＞60mg/dl
D. ＞70mg/dl
E. ＞80mg/dl

正确答案：D。＞70mg/dl

解析：当血中酮体水平（＞70mg/dl）高过肾脏重吸收能力时，尿中就会出现酮体，即为酮症。掌握“脂肪的分解代谢”知识点。